对毒鼠强的中毒表现和解救方法描述正确的有
A. 中毒表现为阵挛性惊厥，类似癫痫大发作
B. 轻度中毒表现为头痛、头晕、乏力、意识丧失和抽搐
C. 解救时应将病人置于新鲜空气处清水洗胃
D. 立即使用维生素K150mg静脉注射
E. 立即肌内注射盐酸吗啡或哌替啶

正确答案：A、B、C。中毒表现为阵挛性惊厥，类似癫痫大发作；轻度中毒表现为头痛、头晕、乏力、意识丧失和抽搐；解救时应将病人置于新鲜空气处清水洗胃